肾癌的病理表现是
A. 切面金黄色，彩色
B. 切面灰黑色
C. 在肾上级，有薄膜
D. 在肾中央
E. 双肾累及，多个癌肿

正确答案：A。切面金黄色，彩色

解析：肾癌的病理表现是切面金黄色，彩色（A对）。切面灰白色一般见于肾母细胞瘤（B错）。在肾上级，有薄膜一般见于嗜铬细胞瘤（C错）。在肾中央一般可见于肾盂癌（D错）。双肾累及，多个癌肿一般可见于双肾多发性恶性肿瘤（E错）。